试戴时，可采用如下方法判断垂直距离是否正确，除了
A. 戴入义齿后，是否不敢张口
B. 面部比例是否自然协调
C. 鼻唇沟，颏唇沟深度是否合适
D. 说话时上下牙之间是否有碰击声
E. 面容是否苍老

正确答案：A。戴入义齿后，是否不敢张口

解析：本题考查判断垂直距离是否正确的方法。戴入义齿后，是否不敢张口（A错，为本题的正确答案）可用于检测义齿的固位作用，不能判断垂直距离恢复是否正确。面下1/3距离增大证明垂直距离恢复过大，面下1/3距离减小证明垂直距离恢复过小（B对）。垂直距离恢复得过大，颏唇沟变浅，垂直距离恢复过小，鼻唇沟变浅（C对）。垂直距离恢复得过大，在说话和进食时可出现后牙相撞声（D对）。垂直距离恢复过小，面容苍老（E对），看上去患者似没戴义齿。